意识清楚，记忆力差，生活自理能力下降，缺乏同情心，本能活动增多
A. 情感淡漠
B. 抑郁状态
C. 痴呆状态
D. 脑衰弱综合征
E. 缄默状态

正确答案：C。痴呆状态

解析：该患者以记忆力差（记忆障碍）为主要表现，意识清楚，生活自理能力下降（对个人生活能力有影响），故诊断为痴呆（C对）。情感淡漠表现为面部表情呆板，对周围发生的事物漠不关心，即使对与自身有密切利害关系的事情也如此（A错）。抑郁发作以显著而持久的情感低落为主要表现，伴有兴趣缺乏、快感缺失（B错）。